某患者因急性阑尾炎穿孔手术，切除术后6天，腹部胀痛不适，呈持续性，伴恶心呕吐，未排便排气。查体：全腹膨胀，肠鸣音消失，腹部X线平片，小肠及结肠均有多量充气及液气平面，进一步应采取
A. 剖腹探查
B. 全胃肠钡餐透视
C. 胃肠减压支持疗法
D. 腹腔穿刺，灌洗
E. 以上均不合适

正确答案：C。胃肠减压支持疗法

解析：急性阑尾炎穿孔切除术后6天，腹部胀痛不适，呈持续性，伴恶心呕吐，未排便排气（肠梗阻的典型表现），查体：全腹膨胀，肠鸣音消失，腹部X线平片：小肠及结肠均有多量充气及液气平面（肠梗阻的典型X线表现），根据该患者的病史、临床症状及体征、影像学表现考虑最可能的诊断为术后继发的黏连性肠梗阻，且无明确绞窄，多为炎症及粘连所引起，大多数经非手术治疗后粘连可以吸收，症状消除，术后炎症及粘连所引起肠梗阻，大多数经非手术治疗后粘连可以吸收，症状消除，应首选胃肠减压支持疗法（C对）。剖腹探查（A错）多用于病情紧急且病因不明确者，该患者的病因已很明确。肠梗阻患者不可以做全胃肠钡餐透视（B错）。腹腔穿刺，灌洗（D错）主要用于腹部损伤的病因的查找及诊断。